周某，男性，42岁。2天前突然出现右上腹部疼痛，经检查诊断为胆囊结石并急性胆囊炎，给予禁食、抗生素等治疗无缓解，最佳的处理方法应是
A. 加大抗生素的用量
B. 调整抗生素
C. 胃肠减压
D. 行术前准备，常规胆囊切除
E. 行术前准备，腹腔镜胆囊切除

正确答案：E。行术前准备，腹腔镜胆囊切除

解析：急性胆囊炎手术适应证1)发病在48～72小时以内者。2)经非手术治疗无效且病情恶化者。3)有胆囊穿孔、弥漫性腹膜炎、急性化脓性胆管炎、急性坏死性胰腺炎等并发症者。掌握“急性胆囊炎”知识点。